人类免疫缺损病毒（HIV）在人体内作用的靶细胞是
A. CD4⁺T淋巴细胞
B. CD8⁺T淋巴细胞
C. B淋巴细胞
D. NK细胞
E. CTL细胞

正确答案：A。CD4⁺T淋巴细胞

解析：本题考查人类免疫缺损病毒（HIV）在人体内作用的靶细胞。人类免疫缺损病毒（HIV）在人体内作用的靶细胞是CD4⁺T淋巴细胞（A对BCDE错）。